第二心音听诊的特点是
A. 音调较低
B. 强度较响
C. 历时较长
D. 不如第一心音清脆
E. 心底听诊最清楚

正确答案：E。心底听诊最清楚

解析：第二心音的听诊特点是音调较高而脆（AD错），强度较S1（第一心音）弱（B错），历时较短（约0.08秒）（C错），不与心尖搏动同步，在心底部最响（E对）。第一心音的听诊特点是音调较低钝，强度较响，历时较长（持续约0.1秒），与心尖搏动同时出现，在心尖部最响（八版诊断学P152 表3-5-11）。